高血压合并糖尿病，血肌酐正常，选用下列哪类降压药最合适
A. 血管紧张素转化酶抑制剂
B. 利尿剂
C. β受体阻滞剂
D. 钙离子拮抗剂
E. α受体阻滞剂

正确答案：A。血管紧张素转化酶抑制剂

解析：高血压合并糖尿病患者最合适的降压药是血管紧张素抑制剂（A对）。因为血管紧张素抑制剂（ACEI）可抑制交感-肾素-血管紧张素-醛固酮系统，扩张外周血管而降低血压；还可改善胰岛素抵抗、减少尿蛋白形成，因此特别适合于高血压合并糖尿病的患者。利尿剂（B错）可使血脂、血糖、血尿酸升高，β受体阻滞剂（C错）能增加胰岛素抵抗，还可能掩盖和延长低血糖反应（P253），两者都不适合用于糖尿病伴高血压患者。钙通道阻滞剂（P255）（D错）对血脂、血糖等无明显影响，可用于高血压合并糖尿病患者，但并非最合适的用药。用于抗高血压治疗的α受体阻滞剂（E错）主要为α₁受体阻滞剂，如哌唑嗪、特拉唑嗪等，因其副作用较多，目前不主张单独使用。